男，55岁。饮酒后出现上腹持续性刀割样痛3小时。尿淀粉酶正常，腹部平片未见膈下游离气体及气液平面。最可能的诊断是
A. 消化道穿孔
B. 胆结石
C. 急性胆囊炎
D. 急性肠梗阻
E. 急性胰腺炎

正确答案：E。急性胰腺炎

解析：中年男性患者，饮酒后出现上腹持续性刀割样痛，腹部平片未见膈下游离气体及气液平面（可排除消化性溃疡穿孔和肠梗阻），最可能的诊断是急性胰腺炎（E对）。患者发病仅3小时，而尿淀粉酶在发病后24小时方升高。消化道穿孔（P340）（A错）立位腹部平片可见膈下游离气体；胆结石（P439）（B错）多表现为右上腹阵发性疼痛或持续性疼痛阵发加重，疼痛可向右肩胛部和背部放射；急性胆囊炎（P443）（C错）多表现为发热、上腹部阵发性绞痛，常伴恶心、呕吐等消化道症状；急性肠梗阻（P358）（D错）多表现为腹部阵发性绞痛、呕吐、腹胀、停止自肛门排气排便，立位腹部平片可见胀气肠袢和气液平面。